女，66岁。2小时前跌倒时手掌着地受伤。查体：右腕明显肿胀，压痛（+），侧面观呈“银叉样”畸形。最可能的诊断是
A. Galeazzi骨折
B. Colles骨折
C. Chance骨折
D. Monteggia骨折
E. Smith骨折

正确答案：B。Colles骨折

解析：患者老年女性，手掌着地受伤史，右腕明显肿胀，压痛（+），侧面观呈“银叉样”畸形，其最可能的诊断为Colles骨折（B对）。Colles骨折又叫伸直型桡骨远端骨折，由于骨折远端向桡、背侧移位，近端向掌侧移位，因此表现为典型的“餐叉”样畸形（侧面观）、“枪刺样”畸形（正面观）。Smith骨折（P642）（E错）即屈曲型桡骨远端骨折，多由于跌倒时腕关节屈曲、手背着地所致。Monteggia骨折（P640）（D错）指尺骨上1/3骨干骨折合并桡骨头脱位。Galeazzi骨折（P640）（A错）指桡骨下1/3骨折合并尺骨小头脱位。Chance骨折（P684）（C错）主要指经椎体、椎弓及棘突的横向骨折。